“水火既济”是指
A. 心与肝的关系
B. 心与肾的关系
C. 心与脾的关系
D. 心与肺的关系
E. 脾与肾的关系

正确答案：B。心与肾的关系

解析：本题考查的是五脏之间的关系。“水火既济”是指心与肾的关系（B对）。心与肾的关系，主要表现在心肾阴阳水火既济与心血肾精之间的依存关系。1.心肾相交：心在五行属火，位居于上而属阳；肾在五行属水，位居于下而属阴。在正常情况下，心火必须下降于肾，助肾阳以温肾水，使肾水不寒；肾水必须上济于心，滋心阴以濡心阳，使心火不亢，如此维持心肾阴阳水火协调平衡，称“心肾相交”，又称“水火既济”。2.精血互生：心主血，肾藏精，血化为精，精能生血，这种精血互生关系，体现了心肾之间的相关性。心与肝的关系（A错）主要表现在血液与神志方面的依存与协同。心与脾的关系（C错），主要表现在血液的生成和运行两方面。心与肺的关系（D错），主要表现在心主血与肺主气、心主行血与肺主呼吸之间的关系。脾与肾的关系（E错），主要表现于先天后天相辅相成和津液代谢方面。